动脉圆锥是
A. 左心室流入道
B. 右心室流入道
C. 左心室流出道
D. 右心室流出道
E. 动脉导管未闭合而形成

正确答案：D。右心室流出道

解析：右心室流出道（D对）又称动脉圆锥或漏斗部。